主要引起肺癌的物质是
A. 氯乙烯、氯甲醚、砷、铬酸盐
B. 联苯胺、氯甲醚、砷、苯
C. 苯、氯甲醚、砷、铬酸盐
D. 氯甲醚、砷、焦炉逸散物、铬酸盐
E. 联苯胺、氯甲醚、砷、铬酸盐

正确答案：D。氯甲醚、砷、焦炉逸散物、铬酸盐

解析：本题考查引发职业性肺癌的物质。在职业性肿瘤中，呼吸道肿瘤占了极高比例。我国现行的《职业病分类和目录》中，可引起职业性呼吸系统肿瘤的职业性有害因素包括：石棉、氯甲醚、二氯甲醚、砷及其化合物、焦炉逸散物、六价铬化合物（D对ABCE错）、毛沸石。